在病因推断中，反映关联强度的指标为
A. 人群归因危险度
B. 相对危险度
C. 归因危险度
D. 特异危险度
E. 以上都不是

正确答案：B。相对危险度